应用麦角胺咖啡因可治疗
A. 原因不明头痛
B. 三叉神经痛
C. 紧张和焦虑性头痛
D. 反复性偏头痛
E. 丙酮与乳酸堆积的头痛

正确答案：D。反复性偏头痛

解析：本题考查麦角胺咖啡因的适应证。应用麦角胺咖啡因可治疗反复性偏头痛（D对）。伴有反复性偏头痛推荐应用抗偏头痛药，如麦角胺咖啡因、罗通定、苯噻啶。三叉神经痛（B错）首选卡马西平、加巴喷丁，如无效可继服苯妥英钠、巴氯芬、阿米替林等药物。紧张和焦虑性头痛（C错）可选地西泮。